畸形中央尖最可能出现在牙冠的
A. 颊嵴
B. 中央窝
C. 近中窝
D. 远中窝
E. 舌嵴

正确答案：B。中央窝

解析：本题考查畸形中央尖。畸形中央尖最常见于牙冠的中央窝（B对）处，也可在颊嵴（A错）、近中窝（C错）、远中窝（D错）、舌嵴（E错）出现，但不如中央窝常见。